洛夏测验作为一种心理测验，其所用的方法是
A. 投射法
B. 问卷法
C. 作业法
D. 观察法
E. 会谈法

正确答案：A。投射法